人体生物利用度测定中，采集血样时间至少应为
A. 1个半衰期
B. 2个半衰期
C. 7个半衰期
D. 5个半衰期
E. 10个半衰期

正确答案：D。5个半衰期